医学伦理学的研究内容不包括以下哪一项
A. 医学伦理学的基本理论
B. 医学伦理学的基本准则规范
C. 伦理学产生发展及其规律
D. 医学道德教育评价和修养
E. 医学道德中的特殊问题

正确答案：C。伦理学产生发展及其规律

解析：医学伦理学研究的内容主要包括：医学伦理学的基本理论（A对）；基本的医学伦理原则、规范（B对）和范畴；预防医学、临床医学、医学科研、医院管理、卫生经济与医疗保健政策等领域引发的伦理题及分析框架；医学道德实践以及医学道德教育（DE对）、修养及评价监督、医学专业精神。